孕期营养不良可引起先天畸形的营养素是
A. 维生素A、维生素B₁、叶酸
B. 维生素A、叶酸、锌
C. 维生素B、叶酸、钙
D. 维生素B、叶酸、锌
E. 维生素A、锌、钙

正确答案：B。维生素A、叶酸、锌